母儿血型不合热毒证的治疗方剂为
A. 茵陈二黄汤
B. 茵陈寄生汤
C. 二丹茜草汤
D. 知柏地黄丸
E. 茵陈五苓散

正确答案：B。茵陈寄生汤

解析：母儿血型不合热毒证主要由于孕期摄生不慎，湿热邪毒直客胞中，或宿有湿热内蕴胞中，日久化为毒，伤及胎体。治宜清热解毒，利湿安胎，方用清热祛湿，补肾安胎之茵陈寄生汤（B对）。母儿血型不合之湿热内蕴证的治疗方剂为茵陈二黄汤（A错）；阴虚血热证的治疗方剂为知柏地黄丸（D错）加茵陈、桑寄生、菟丝子。母儿血型不合之瘀热互结证的治疗方剂是二丹茜草汤（C错）。茵陈五苓散（E错）主治湿热黄疸，湿重于热，小便不利者。